在下列工业生产中，哪项不宜采用湿式作业
A. 采煤
B. 开凿隧道
C. 水泥生产
D. 矿山开采
E. 井下运输

正确答案：C。水泥生产